绿色食品标志不包括
A. 绿色
B. 黄色
C. 太阳
D. 叶片
E. 蓓蕾

正确答案：B。黄色

解析：本题考查绿色食品标志。绿色食品标志图形由三部分组成，即上方的太阳（C对）、下方的叶片（D对）和中心的蓓蕾（E对）。标志为圆形，意为保护、安全。AA级绿色食品标志与标准字体为绿色（A对），底色为白色；A级绿色食品标志与标准字体为白色，底色为绿色。绿色食品标志不包括黄色（B错，为本题正确答案）。